不易由低镁血症引起的症状是
A. 四肢肌肉震颤
B. 癫痫发作
C. 血压降低
D. 心律失常
E. 低钙血症和低钾血症

正确答案：C。血压降低

解析：Mg2+和Ca2+竞争进入轴突，低镁血症时则Ca2+进入增多，导致轴突释放乙酰胆碱增多，使神经-肌肉接头处兴奋传递加强而出现四肢肌肉震颤（A对）。镁对中枢神经系统具有抑制作用，严重镁缺乏时可出现癫病发作（B对）。镁缺乏时血管平滑肌细胞内钙含量增高，使血管收缩，外周血管阻力增大，血压升高（C错，为本题正确答案）。低镁血症肾脏对钾的重吸收减少而出现低钾血症，镁缺乏使甲状旁腺分泌PTH减少，同时靶器官对PTH的反应性减弱，肠道吸收钙、肾小管重吸收钙和骨钙动员均发生障碍，导致血钙浓度降低（E对）。镁缺乏可使Na+-K+-ATP酶活性降低，心肌细胞缺钾而出现心律失常（D对）。